移民美国的中国人，其谦逊的美德与个人至上环境常发生冲突，由此产生适应不良，这种冲突属于
A. 躯体性应激源
B. 文化性应激源
C. 社会性应激源
D. 心理性应激源
E. 职业性应激源

正确答案：B。文化性应激源